关于五脏所藏的叙述，错的是
A. 心藏神
B. 肝藏魂
C. 肺藏魄
D. 脾藏意
E. 肾藏神

正确答案：E。肾藏神

解析：《素问·宣明五气》说：“心藏神（A对），肺藏魄（C对），肝藏魂（B对），脾藏意（D对），肾藏志”（E错，为本题正确答案）。